CD4⁺T细胞发挥抗病毒作用的主要机制不包括
A. 辅助抗体产生
B. 杀伤被感染细胞
C. 产生免疫记忆
D. 活化CD8+细胞
E. 分泌细胞因子

正确答案：B。杀伤被感染细胞

解析：病毒被摄取、加工、提呈抗原，激活CD4⁺T细胞，为初始CD8⁺T细胞的活化（D对）提供IL-2，还可以为B细胞提供细胞因子（E对），促进B细胞产生抗体（A对）。CD4⁺T细胞介导的是适应性免疫，因此会产生免疫记忆（C对）（P2）。杀伤被感染细胞（B错）主要见于CD8⁺T细胞应答（P172）。